青黛的鉴别特征有
A. 极细的深蓝色粉末
B. 质轻，能浮于水面
C. 味极苦
D. 火烧产生紫红色烟雾
E. 粉末滴加硝酸，立即产生气泡，并显棕红色或黄棕色

正确答案：A、B、D、E。极细的深蓝色粉末；质轻，能浮于水面；火烧产生紫红色烟雾；粉末滴加硝酸，立即产生气泡，并显棕红色或黄棕色

解析：本题考查的是中药材的性状鉴别。青黛的鉴别特征有极细的深蓝色粉末（A对）、质轻，能浮于水面（B对）、火烧产生紫红色烟雾（D对）与粉末滴加硝酸，立即产生气泡，并显棕红色或黄棕色（E对）。青黛：【性状鉴别】药材为深蓝色的粉末，体轻，易飞扬；或呈不规则多孔性的团块、颗粒，用手搓捻即成细末。微有草腥气，味淡（C错）。取本品少量，用微火灼烧，有紫红色烟雾发生。取本品少量，滴加硝酸，产生气泡并显棕红色或黄棕色。